根据《药品经营质量管理规范》及其有关附录文件，属于冷库、冷藏车、保温箱共有的验证项目是
A. 测点终端安装数量及位置确认
B. 测点终端参数与数据联动传输确认
C. 运输最长时限验证
D. 极端温度保温性能验证

正确答案：D。极端温度保温性能验证

解析：本题考查的是药品经营质量管理规范附录文件《验证管理》。根据《药品经营质量管理规范》及其有关附录文件，属于冷库、冷藏车、保温箱共有的验证项目是极端温度保温性能验证（D对）。冷库的验证项目包括：库内温度分布特性（稳定性验证持续时长不得小于48小时），温控设备运行状况，测点终端参数与安装位置确认，开门作业对库内温度影响，冷库断电保护功能确认，极端温度保温性能，新库（含改造后重启）空载、满载验证，年度满载验证。冷藏车的验证项目包括：车厢内温度分布特性（稳定性验证持续时长不得小于5小时），温控设备运行状况，测点终端参数与安装位置确认，开门作业对车厢内温度影响，车厢析电保护功能确认，极端温度保温性能，新车空载、满载验证，年度满载验证。冷藏箱（保温箱）验证项目包括：箱内温度分布特性，蓄冷剂配备使用（蓄冷剂与保温箱采取摆列组合式捆绑验证），测点终端位置（A错），开箱作业对箱内温度影响，极端温度保温性能，运输最长时限验证（C错）。